中药厚朴中含有的厚朴酚是
A. 双环氧木脂素类
B. 联苯环辛烯型木脂素类
C. 木脂内酯木脂素类
D. 联苯型木脂素类
E. 简单木脂素类

正确答案：D。联苯型木脂素类

解析：本题考查的是联苯型木脂素。中药厚朴中含有的厚朴酚是联苯型木脂素类（D对）。从中药厚朴树皮中分离得到的厚朴酚及日本厚朴树皮中分到的和厚朴酚是典型的联苯型木脂素类化合物。双环氧木脂素（A错）是由两分子苯丙素侧链相互连接形成两个环氧结构的一类木脂素，即具有双骈四氢呋喃环结构。联苯环辛烯型木脂素（B错）的结构中既有联苯结构，又有联苯与侧链环合成的八元环状结构。至今已发现60多个化合物，其主要来源是五味子属植物，如五味子醇、五味子素等。木脂内酯（C错）该类木脂素是在简单木脂素基础上，9-9’位环氧、C₉为羰基，即单环氧木脂素中的四氢呋喃环氧化成内酯环。简单木脂素（E错）由两分子苯丙素仅通过β位碳原子连接而成。此类化合物也是其他一些类型木脂素的生源前体。